为患者制定给药方案的基本方法有
A. 根据国际标准化比值（INR）调整华法林的给药剂量
B. 根据药物消除半衰期确定给药间隔
C. 根据治疗药物监测（TDM）结果制定给药方案
D. 根据平均稳态血药浓度和给药间隔确定给药剂量
E. 根据PK/PD参数制定抗菌药物给药方案

正确答案：B、D。根据药物消除半衰期确定给药间隔；根据平均稳态血药浓度和给药间隔确定给药剂量

解析：本题考查制定给药方案的方法。制订给药方法的方法：1.根据半衰期制订给药方案（B对）；2.根据平均稳态血药浓度制订治疗方案（D对）。根据国际标准化比值（INR）调整华法林的给药剂量（A错）、根据治疗药物监测（TDM）结果制定给药方案（C错）、根据PK/PD参数制定抗菌药物给药方案（E错）为调整给药方案的方法。